与气生成不直接相关的是
A. 水谷之精气
B. 肾藏的精气
C. 肝气的疏泄
D. 自然界吸入的清气
E. 禀受于父母先天之精气

正确答案：C。肝气的疏泄

解析：本题考查的是气的生成。与气生成不直接相关的是肝气的疏泄（C错，为本题正确答案）。气的生成：气来源于父母先天之精气（E对）、后天饮食物中的水谷精微（A对）以及从自然界吸入的清气（D对）。1.先天之气：先天之气为先天之精所化生，依赖于肾藏精（B对）的生理功能，才能充分发挥生理作用。2.后天之气：水谷之精气，依赖于脾胃的运化功能，才能从饮食水谷中化生；自然界的清气，则依赖于肺的呼吸功能，才能吸入人体。因此，气的生成，除与先天禀赋、后天饮食营养，以及自然环境等状况有关外，还与肾、脾胃、肺等脏腑的生理功能密切相关。